失血性休克扩充血容量首选的液体是
A. 全血
B. 中分子右旋糖苷
C. 平衡盐溶液
D. 血浆
E. 10%葡萄糖溶液

正确答案：C。平衡盐溶液

解析：失血性休克时，虽然丢失的主要成分是血液，但补充血容量时，并不需要全部补充血液，而应抓紧扩容，及时增加静脉回流，保证机体重要脏器灌注。失血性休克扩充血容量应首选平衡盐溶液（C对），其电解质浓度、渗透压与体液相似，扩容效果好。全血（A错）成分多样，易发生输血反应、造成浪费。此外输注全血、血浆（D错）等血制品前都须经过严格的配血试验，如一味等待，患者可能因失血过多而死亡。中分子右旋糖苷（B错）与10%葡萄糖溶液（E错）虽可迅速补充血容量，但其缺乏电解质，可导致患者电解质失衡。